人体处在交感兴奋状态时，尿量减少的主要原因是
A. 肾小球毛细血管血压下降
B. 血浆胶体渗透压升高
C. 肾素分泌减少
D. 醛固酮分泌减少
E. 抗利尿激素分泌减少

正确答案：A。肾小球毛细血管血压下降

解析：肾交感神经兴奋时，引起肾血管收缩而减少肾血流量，肾小球毛细血管血压下降（A对），肾小球滤过率下降，尿量减少。肾交感神经兴奋时，不会引起血浆胶体渗透压升高（B错）。肾交感神经兴奋时，通过激活β受体，使球旁器的颗粒细胞释放肾素，肾素分泌增加（C错），通过肾素-血管紧张素-醛固酮系统，醛固酮分泌增加（D错）。抗利尿激素分泌减少（E错），可使尿量增加，与题干不符。